某一艾滋病女患者，出现严重的肺炎，痰涂片发现有孢子存在，试问最有可能的病原体是哪种
A. 曲霉菌
B. 新生隐球菌
C. 毛霉菌
D. 卡氏肺孢菌
E. 小孢子癣菌

正确答案：D。卡氏肺孢菌

解析：卡氏肺孢子菌性肺炎是由卡氏肺孢菌感染引起的间质性肺炎。此病是艾滋病最常见的机会性感染，也见于免疫功能抑制者。肺孢子菌过去一直被认为是原虫，称为卡氏肺囊虫，但事实上它是一种真菌。血清学检测显示几乎每个人在出生后都受到肺孢菌的感染，只是呈隐性感染，不引起任何症状。掌握“真菌概述及主要病原性真菌”知识点。